小儿“地图舌”是由于
A. 肺气虚弱
B. 脾阳亏虚
C. 脾失健运
D. 宿食内停
E. 胃之气阴不足

正确答案：E。胃之气阴不足

解析：小儿“地图舌”是指舌苔花剥，状如地图，时隐时现，经久不愈，多为胃之气阴不足所致，故“地图舌”是由于胃之气阴不足(E对)。肺气虚弱，苔白（A错）。脾阳亏虚，苔白腻（B错）。脾失健运则水湿内停，为腻苔（C错）。宿食内停，中焦气机阻滞，舌苔厚腻垢浊不化，状如霉酱（D错）。